瘢痕性幽门梗阻病人术前纠正体液代谢和酸碱失衡时，选用的液体是
A. 1.25%碳酸氢钠液
B. 1.25%碳酸氢钠液+5%葡萄糖液
C. 5%葡萄糖液+1/6mmoL乳酸钠液
D. 氯化钾+5%葡萄糖盐水
E. l/6mmoL乳酸钠液

正确答案：D。氯化钾+5%葡萄糖盐水

解析：瘢痕性幽门梗阻病人严重持久的呕吐，胃液大量丢失，易出现低氯、低钾性碱中毒。术前纠正体液代谢和酸碱失衡时，宜选用氯化钾+5%葡萄糖盐水（D对）。氯化钾既能补钾又能纠正碱中毒（缺钾时，K⁺从细胞内移至细胞外，每释出3个K⁺就有2个Na⁺和1个H⁺移入，肾远曲小管上皮细胞中H⁺的增高导致经尿排H⁺增多。补钾之后可纠正细胞内、外离子的异常交换，终止从尿中继续排H⁺，将有利于碱中毒的治疗）；5%葡萄糖盐水为等渗溶液，既可迅速补充血容量又能补充Cl⁻。碳酸氢钠液（AB错）与乳酸钠（CE错）可用于治疗重症酸中毒与高钾血症。